不属于化妆品的是
A. 牙膏
B. 杀螨洗发水
C. 脱毛膏
D. 面膜
E. 眉笔

正确答案：B。杀螨洗发水

解析：本题考查化妆品。化妆品是指以涂擦、喷洒或其他类似方法，散布于人体表面（皮肤、毛发、指甲、口唇等）、牙齿以及口腔黏膜，以清洁、保护、美化、修饰以及保持其处于良好状态为目的的产品。牙膏（A对）、脱毛膏（C对）、面膜（D对）和眉笔（E对）都属于化妆品。杀螨洗发水（B错，为本题正确答案）不属于化妆品。